6岁女孩，诊断为“肾病综合征”，因水肿、尿少，膝反射减弱，心音低顿，心电图出现U波，治疗中需及时补充
A. 钠盐
B. 钾盐
C. 钙剂
D. 镁剂
E. 维生素B1

正确答案：B。钾盐

解析：6岁女孩患有肾病综合征后可有电解质紊乱的并发症，常见的有低钠、低钾及低钙血症，其中低血钾常有u波明显增高的心电图表现，故在治疗中应及时补充钾盐（B对）。而钠盐（A错）常用于低钠血症，钙剂（C错）常用于低钙血症，而镁剂（D错）常用于低镁血症，维生素B1（E错）常用于神经炎等。